下述关于生产环境监测论述不正确的是
A. 掌握生产环境中有害因素的性质、强度和分布情况
B. 了解生产环境卫生质量
C. 估计人体接触水平
D. 评价职业性有害因素对劳动者健康危害程度
E. 对所观察的有害因素进行分析评价

正确答案：D。评价职业性有害因素对劳动者健康危害程度